不属于血友病重患者的表现为
A. 尿血
B. 咯血
C. 流鼻血
D. 呕血
E. 黑便

正确答案：C。流鼻血

解析：血友病出血多为自发性或轻度外伤后出血不止，且具备下列特征：①生之具有，伴随终身；②常表现为软组织或深部肌肉内血肿，负重关节如膝、踝关节等反复出血甚为突出，最终可致关节肿胀、僵硬、畸形，可伴骨质疏松、关节骨化及相应肌肉萎缩（血友病关节），重症患者可有内脏出血，如尿血、咯血、呕血和黑便，偶有颅内出血；③迟发性出血，最常见于拔牙后，当时常无出血，而过一段时间后会出血不止。掌握“血友病”知识点。